维生素A、维生素B和维生素E类缺乏，可引起口腔癌的发生，说明口腔颌面肿瘤可能与哪项致病因素有关
A. 物理因素
B. 化学因素
C. 生物因素
D. 营养因素
E. 内分泌因素

正确答案：D。营养因素

解析：营养因素：与口腔癌发生有关的维生素主要是维生素A、维生素B和维生素E类缺乏；在微量元素方面发现人体内硒（Se）、锗（Ge）、铜（Cu）、锌（Zn）等的含量与比值，以及胡萝卜素类化合物均与癌瘤的发生、发展有一定关系。掌握“口腔颌面部肿瘤的概念、临床表现、诊断”知识点。